患者，女，35岁，近日去植物园游玩后出现双眼结膜充血、瘙痒伴流泪，无分泌物，诊断为过敏性结膜炎。宜选用的药物是
A. 红霉素滴眼液
B. 色甘酸钠滴眼液
C. 酞丁安滴眼液
D. 阿昔洛韦滴眼液
E. 左氧氟沙星滴眼液

正确答案：B。色甘酸钠滴眼液

解析：本题考查结膜炎用药。宜选用的药物是色甘酸钠滴眼液（B对）。色甘酸钠滴眼液可用于治疗过敏性结膜炎，其不仅可抑制炎症过程的早期表现，还能降低毛细血管壁和毛细血管膜的通透性，减少炎症的渗出。红霉素眼膏（A错）对革兰阳性菌和沙眼衣原体有抗菌作用。适用于沙眼、结膜炎、角膜炎。酞丁安滴眼液（C错）可以在沙眼包涵体未形成时，阻止沙眼衣原体繁殖和包涵体的形成，具有较强的抑制沙眼衣原体的作用，对沙眼有很好的疗效。阿昔洛韦滴眼液（D错）用于单纯疱疹性角膜炎。左氧氟沙星滴眼液（E错）可用于治疗由细菌所致的结膜炎。